根据传染病学防治法，甲类传染病学除了霍乱外，还包括
A. 流行性感冒
B. 流行性腮腺炎
C. 鼠疫
D. 麻风病
E. 百日咳

正确答案：C。鼠疫

解析：鼠疫属国际检疫传染病和我国法定的甲类管理传染病（C对）。流行性感冒，简称流感，是由甲、乙、丙三型流感病毒分别引起的一种急性呼吸道疾病，属于丙类传染病（A错）。流行性腮腺炎，简称流腮，俗称痄腮，是全球性的流行性疾病。属于国家法定传染病的一个丙类传染病（B错）。麻风病属于丙类传染病（D错）。百日咳属于乙类传染病（E错）。